脂肪乳化主要物质是
A. 贮能和供能
B. 磷脂、胆固醇和不饱和脂肪酸
C. 前列腺素、血栓曙烷及白三烯
D. 胆汁酸盐、辅脂酶与胰脂酶
E. 小肠

正确答案：D。胆汁酸盐、辅脂酶与胰脂酶